某女，49岁，经血非时而下，出血量多，淋沥不尽，色淡质稀，两目干涩，腰膝酸软，面色晦暗，舌淡暗，脉沉弱。根据治法，宜选用的方剂是
A. 健固汤加减
B. 调肝汤加减
C. 丹栀逍遥散加减
D. 归脾汤加减
E. 逐瘀止崩汤加减

正确答案：B。调肝汤加减

解析：本题考查的是崩漏的辨证论治。经血非时而下，出血量多，淋沥不尽，色淡质稀，两目干涩，腰膝酸软，面色晦暗，舌淡暗，脉沉弱。根据治法，宜选用的方剂是调肝汤加减（B对）。崩漏是月经的周期、经期、经量发生严重失常的病证，经血非时暴下不止或不尽，前者谓之崩中，后者谓之漏下。崩与漏出血情况虽不同，然二者常相互转化，交替出现，且其病因病机基本相同，故概称崩漏。西医学中的无排卵性功能性子宫出血，可参照本证进行辨证治疗。气血两虚证：【症状】出血量多或淋沥不尽，血色淡薄，面色无华，气短懒言，食欲不振，便溏。舌质淡，苔薄白湿润，脉细弱。【方剂应用】基础方剂归脾汤（D错）去当归、茯神、远志（人参、黄芪、白术、酸枣仁、木香、龙眼肉、甘草、生姜、大枣）加党参、茜草、乌贼骨、仙鹤草。肝肾不足证：【症状】月经非时而下，或月经先期，经期延长，经血暗红，量少而淋沥不畅，咽干颧红，心烦潮热，腰膝酸软。舌红苔少或光剥苔，脉沉细无力。【方剂应用】基础方剂调肝汤（当归、白芍、山茱萸、巴戟天、阿胶、山药、甘草）加减。瘀血阻络证：【症状】经血非时而下，量时多时少，时出时止，或淋沥不断，或停闭数月又突然崩中，继之漏下，经色暗有血块；舌质紫暗或尖边有瘀点，脉弦细或涩。【方剂应用】基础方剂逐瘀止血汤（生地黄、大黄、赤芍、丹皮、当归尾、枳壳、龟甲、桃仁）或将军斩关汤（熟军炭、巴戟天、仙鹤草、茯神、蒲黄、炒阿胶、黄芪、炒当归、白术、生地、熟地、焦谷芽）加减（E错）。内伤发热气郁发热证【症状】发热多为低热或潮热，热势常随情绪波动而起伏，精神抑郁，胁肋胀满，烦躁易怒，口干而苦，纳食减少。舌红，苔黄，脉弦数。【方剂应用】基础方剂丹栀逍遥散（丹皮、栀子、当归、白芍、柴胡、茯苓、白术、甘草、薄荷、煨姜）加减（C错）。方剂应用为健固汤加减（A错）的病证，2022年考试指南未明确说明。